注射硬化剂用于治疗
A. 急性关节前脱位
B. 翼外肌功能亢进
C. 可复性关节盘前移位
D. 复发性关节脱位
E. 陈旧性脱位

正确答案：D。复发性关节脱位

解析：本题考查复发性关节脱位的治疗。颞下颌关节疾病的种类较多，治疗方法也各有侧重，不尽相同。复发性关节脱位，单纯限制下颌活动不能达到防止再脱位的目的，一般注射硬化剂可用于治疗复发性关节脱位（D对）。翼外肌功能亢进（B错）的治疗主要是调整翼外肌功能，可采用翼外肌封闭同时配合肌训练，减弱翼外肌收缩的力量。可复性关节盘前移位（C错）的治疗以保护关节为主，对患者进行健康教育，避免食用不易咀嚼的食物，局部湿热敷，也可采用再定位咬合板消除关节弹响。急性关节前脱位（A错）应及时复位，并在复位后限制下颌运动。陈旧性脱位（E错）因已有组织学改变，手法复位比较困难，其治疗一般应以手术复位为主。